流行病学任务的三个阶段是
A. 描述分布、提出假设、验证假设
B. 揭示现象、找出原因、提供措施
C. 整理资料、分析资料、得出结论
D. 观察性研究、实验性研究、理论性研究
E. 筛查患者、确诊患者、治疗患者

正确答案：B。揭示现象、找出原因、提供措施

解析：本题考查流行病学任务的三个阶段。流行病学的三个阶段分别为：1.揭示现象：即揭示流行（主要是传染病）或分布（其他疾病、伤害与健康）的现象，可通过描述性流行病学方法来实现；2.找出原因：即从分析现象入手找出流行与分布的规律和原因，可以借助分析性流行病学方法来检验或验证所提出的病因假说；3.提供措施（B对ACDE错）：即合理利用前两阶段的结果，找出预防或控制的策略与措施，可用实验流行病学方法验证。